皮样、表皮样囊肿的特征表现是
A. 生长缓慢
B. 边界清楚
C. 无自觉症状
D. 多见于儿童、青少年
E. 触诊似面团样，坚韧而有弹性

正确答案：E。触诊似面团样，坚韧而有弹性

解析：本题考查皮样或表皮样囊肿的特征表现。皮样、表皮样囊肿的特征表现是触诊似面团样，坚韧而有弹性（E对）。皮样、表皮样囊肿特征表现为触诊似面团样，坚韧而有弹性。皮样、表皮样囊肿生长缓慢（A错），边界清楚（B错），无自觉症状（C错），多见于儿童、青少年（D错）；但皮脂腺囊肿也生长缓慢，边界清楚，一般无自觉症状，囊肿中央有一色素小点与其鉴别；甲状舌管囊肿也多见于儿童、青少年；所以这些虽然是其临床表现，但不是特征表现。